流脑的传播途径主要是
A. 皮肤接触
B. 消化道
C. 呼吸道
D. 性传播
E. 血液

正确答案：C。呼吸道

解析：流脑病原菌主要通过咳嗽、喷嚏等飞沫由呼吸道（C对）直接传播。因病原体在体外生存力极弱，故间接传播的机会极少，但同睡、喂乳、接吻、怀抱等密切接触，对2岁以下婴幼儿的发病有重要意义。